修补加强腹股沟管前壁修补最常见的手术方法是
A. Bassini法
B. Ferguson法
C. McVay法
D. Shouldice法
E. Halsted法

正确答案：B。Ferguson法

解析：加强或修补腹股沟管前壁的方法以Ferguson法最常用（B对）。Bassini法、Shouldice法、Halsted法、McVay修补法是加强或修补腹股沟管后壁的方法，其中McVay修补法也是股疝的常用手术。